女，28岁。己婚，因消瘦、乏力、多食，心悸3个月就诊，近2年来应用口服避孕药。哪项检查对患者诊断最有意义
A. TT₃，TT₄，TSH测定
B. FT₃，FT₄，TSH测定
C. 甲状腺吸碘率测定
D. TSH受体抗体测定
E. TGAb，TPOAb测定

正确答案：B。FT₃，FT₄，TSH测定

解析：青年女性患者（Graves病好发人群），有口服避孕药史，出现消瘦，乏力，多食（高代谢症候群）及心悸（交感神经系统兴奋性增强），考虑诊断为Graves病引起的甲亢。引起甲亢一系列临床表现的关键为血液循环中甲状腺激素过多，导致神经、循环、消化等系统兴奋性增高和代谢亢进。甲状腺激素包括T₃和T₄，其中以游离状态存在的T₃、T₄（FT₃、FT₄）发挥主要作用，但因血中的含量甚微，测定的稳定性不如 TT4、TT3。由于甲状腺激素分泌增多，负反馈性抑制促甲状腺激素（TSH）分泌，导致血液中TSH减少。因此，对于甲状腺功能亢进症的诊断，血TSH、FT₃、FT₄测定（B对A错）最有意义。甲状腺吸碘率测定（C错）目前已经被sTSH（敏感TSH）测定技术所替代。TSH受体抗体（D错）包括TSH受体刺激性抗体（TSAb）和TSH受体刺激阻断性抗体（TSBAb），检测到的TSH受体抗体仅能反映有针对TSH受体抗体存在，不能反映这种抗体的功能（P684）。TgAb和TPOAb测定（E错）亦可见于甲亢，但对于甲亢的诊断价值不大。